下列属于足太阴脾经的穴位是
A. 气冲
B. 大横
C. 期门
D. 梁门
E. 章门

正确答案：B。大横

解析：大横（B对）为足太阴脾经之穴。气冲（A错）为足阳明胃经之穴。期门（C错）为足厥阴肝经之穴。梁门（D错）为足阳明胃经之穴。章门（E错）为足厥阴肝经之穴。